左心室增大时，心尖搏动移位方向是
A. 向右
B. 向左
C. 向右下
D. 向左下
E. 向后

正确答案：D。向左下

解析：左心室增大时，心尖搏动向左下方移位（D对），见于主动脉瓣关闭不全等疾病。